根据牙列缺损的Kennedy分类，33-43缺失者属于
A. 第三类第二亚类
B. 第三类第一亚类
C. 第三类
D. 第四类第二亚类
E. 第四类

正确答案：E。第四类

解析：第四类：义齿鞍基位于基牙的前面，越过中线的前部缺牙，基牙在缺隙的远中。患者为33-43很明显属于第四类：义齿鞍基位于基牙的前面，越过中线的前部缺牙，基牙在缺隙的远中。掌握“局部义齿类型，肯氏分类及模型观测”知识点。